苯巴比妥使避孕药药效下降属于
A. 抵消作用
B. 相减作用
C. 生理性拮抗
D. 生化性拮抗
E. 脱敏作用

正确答案：D。生化性拮抗

解析：本题考查药物相互作用。生化性括抗（D对）是指两药联合用药时一个药物通过诱导生化反应而使另外一个药物的药效降低。例如，苯巴比妥诱导肝微粒体酶活性，使避孕药代谢加速，效应降低，使避孕失败。